引起艾滋病的病原体是
A. HPV
B. HIV
C. EB
D. HBV
E. HCV

正确答案：B。HIV

解析：艾滋病又称获得性免疫缺陷综合征，简称AIDS，由人免疫缺陷病毒，简称HIV感染所致。掌握“艾滋病的口腔表现”知识点。